不含副交感纤维成分的是
A. 动眼神经
B. 舌咽神经
C. 迷走神经
D. 展神经
E. 面神经

正确答案：D。展神经

解析：副交感纤维仅存在第三、七、九、十对脑神经中，展神经（D错，为本题正确选项）为第六对脑神经，为一般躯体运动神经。